关于皮质脊髓束的描述，正确的是
A. 脊髓前束部分纤维经白质前连合越边止于对侧前角运动神经元
B. 脊髓束在脊髓都直接止于前角运动细胞
C. 髓前束纵贯脊髓全长
D. 脊髓内损伤皮质脊髓侧束属下运动神经元损伤
E. 皮质脊髓前束仅止于同侧脊髓灰质前角

正确答案：B。脊髓束在脊髓都直接止于前角运动细胞

解析：脊髓丘脑束（A错）的纤维经白质前连合止于对侧前角运动神经元。皮质脊髓束的大部分纤维与Ⅳ-VIII层的中间神经元形成突触，其余直接与前角外侧核的运动神经元相突触（B对）。